以下药物的含量测定方法为：盐酸去氧肾上腺素
A. 非水溶液滴定法
B. 双相滴定法
C. 溴量法
D. 亚硝酸钠滴定法
E. 沉淀滴定法

正确答案：C。溴量法